中枢神经系统病变导致的溃疡是
A. Cushing溃疡
B. 十二指肠球后溃疡
C. 胃溃疡
D. Curling溃疡
E. 卓艾综合征

正确答案：A。Cushing溃疡

解析：Cushing溃疡（A对）是指在颅脑损伤、颅脑病变或颅内手术后发生的应激性溃疡，是中枢神经系统病变导致的溃疡。十二指肠球后溃疡（B错）指发生在十二指肠降段和水平段的溃疡，夜间痛多见，易出血，疼痛可向右上腹及背部放射。胃溃疡（C错）以胃黏膜功能降低为主要机制，表现为节律性餐后上腹痛。Curling溃疡（D错）是指中度、重度烧伤后引发的胃、十二指肠、食管黏膜的急性糜烂、溃疡、出血等。卓艾综合征（Zollinger-Ellison综合征）（P361）（E错）由促胃液素瘤增生所致，临床以明显的高胃泌素血症、高胃酸分泌、不典型部位消化性溃疡及腹泻为特征。